某患者多食多饮多尿，空腹血糖浓度为10.2mmol/L，尿糖（+）。其尿量增加主要原因是
A. 肾小球滤过率增加
B. 肾小管中溶质浓度增加
C. 肾小管分泌增加
D. 血浆晶体渗透压升高
E. 醛固酮分泌增加

正确答案：B。肾小管中溶质浓度增加

解析：患者多食多饮多尿（糖尿病的临床表现为多食多饮多尿，体重减轻），空腹血糖浓度为10.2mmol/L（正常值3.89～6.1mmol/L），尿糖（+），考虑为糖尿病，尿量增加的原因是由于血糖升高导致的渗透性利尿。由于血糖升高超过肾糖阈和近端小管对糖的最大转运速率，导致小管液葡萄糖浓度升高（B对），渗透压升高，由于渗透作用使一部分水保留在小管内，导致使小管液中的Na⁺被稀释而浓度降低，因此小管液和上皮细胞内Na⁺的浓度梯度减小，从而使Na⁺的重吸收减少或停止，而小管液中较多的Na⁺又通过渗透作用保留相应的水，结果使尿量增多，NaCl排出量增多。肾小球滤过率增加（A错）主要见于血容量增加的情况。血浆晶体渗透压升高（D错）时，抗利尿激素分泌增多，会导致尿量减少。肾小管的分泌（C错）、醛固酮的分泌（E错）与血糖无关。